双胎妊娠的并发症不包括
A. 产程延长
B. 产后出血
C. 早产
D. 巨大胎儿
E. 妊娠期高血压疾病

正确答案：D。巨大胎儿

解析：双胎妊娠孕妇的并发症包括：（1）妊娠期高血压疾病（E对）；（2）妊娠期肝内胆汁淤积症；（3）贫血；（4）羊水过多；（5）胎膜早破；（6）宫缩乏力：子宫肌纤维伸展过度，常发生原发性宫缩乏力，致产程延长（A对）；（7）胎盘早剥；（8）产后出血（B对）；（9）流产。多胎妊娠可引起选择性胎儿生长受限，而不是巨大胎儿（D错，为本题正确答案）。